下述各肌中，哪一块既能屈踝关节（跖屈）又能使足内翻
A. 胫骨前肌
B. 胫骨后肌
C. 腓骨短肌
D. 趾长伸肌
E. 腓骨长肌

正确答案：B。胫骨后肌

解析：胫骨前肌（A错）伸踝关节（背屈），使足内翻；胫骨后肌（B对）既能屈踝关节（跖屈）又能使足内翻；腓骨短肌（C错）和腓骨长肌（E错）屈踝关节（跖屈）和使足外翻；趾长伸肌（D错）伸踝关节（背屈），伸第2～5趾。